上颌第一磨牙远颊根骨吸收2/3以上、近中颊根和腭根骨吸收约1/3、远中和颊根分叉病变Ⅲ度，可选择
A. 截除近中颊根
B. 截除远中颊根
C. 牙半切术
D. 引导组织再生术
E. 牙槽骨成形术

正确答案：B。截除远中颊根

解析：本题考查截根术的适应证。上颌第一磨牙，远中和颊根分叉病变Ⅲ度，腭根骨吸收约1/3病情较轻，符合截根术的适应证，且远颊根骨吸收2/3以上，远颊根无保留价值应截除远中颊根（B对）。近中颊根（A错）和腭根骨吸收约1/3，松动不明显，病情轻，尚可治疗，可予以保留，无需截根。该患牙牙体组织无破坏，故不需要行牙半切术（C错）。引导组织再生术（D错）是牙周手术或种植手术中用来引导牙周组织或骨组织再生的一种技术。牙槽骨成形术（E错）是用于修整不平整的牙槽骨时的手术方法。